毒物动力学中“室”的概念是
A. 表示解剖部位
B. 代表器官
C. 转运和转化性质相近的组织、器官和血液
D. 代表生理学的功能单位
E. 代表毒物作用的靶

正确答案：C。转运和转化性质相近的组织、器官和血液